患者，女，26岁。因左下颌角区渐进性膨隆5个月余就诊。专科检查面部不对称，触诊有乒乓球样感觉。临床初步诊断为左下颌骨牙源性角化囊性瘤。X线片特征为
A. 边缘整齐的透光影像
B. 含牙的透光影像
C. 不含牙的透光影像
D. 沿下颌骨长轴发展，膨胀明显
E. 牙根吸收少见，多呈斜面状

正确答案：E。牙根吸收少见，多呈斜面状

解析：下颌骨牙源性角化囊性瘤X线片透光影像的边缘可整齐也可不整齐，故A不正确，可以含牙也可以不含牙，所以B和C不全面。一般牙源性角化囊性瘤沿下颌骨长轴发展而颌骨膨隆不明显，故D不正确。掌握“牙源性角化囊性瘤”知识点。